在腱反射中，梭外肌纤维属于
A. 感受器
B. 传入神经元
C. 神经中枢
D. 传出神经元
E. 效应器

正确答案：E。效应器

解析：腱反射是指快速牵拉肌腱时发生的牵张反射，是体内唯一的单突触反射。腱反射的感受器是肌梭（A错），传入纤维是Ⅰₐ和Ⅱ类神经纤维（B错），基本中枢位于脊髓（C错），传出纤维是α和γ纤维（D错），效应器是被牵拉肌肉的梭外肌纤维（E对）。